除另有规定外，应检查崩解时限的片剂有
A. 肠溶片
B. 可溶片
C. 缓释片
D. 舌下片
E. 咀嚼片

正确答案：A、B、D。肠溶片；可溶片；舌下片

解析：本题考查的是片剂的质量要求。除另有规定外，应检查崩解时限的片剂有肠溶片（A对）、可溶片（B对）与舌下片（D对）。片剂的崩解时限：除另有规定外，药材原粉片6片均应在30分钟内全部崩解；浸膏（半浸膏）片、糖衣片各片均应在1小时内全部崩解。薄膜衣片在盐酸溶液（9→1000）中检查，化药片应在30分钟内全部崩解；中药片应在1小时内全部崩解。含片的溶化性照崩解时限检查法检查，各片均不应在10分钟内全部崩解或溶化。舌下片各片均应在5分钟内全部崩解并溶化。可溶片各片均应在3分钟内全部崩解并溶化。口崩片应在60秒内全部崩解并通过筛孔内径为710µm的筛网。肠溶片先在盐酸溶液（9→1000）中检查2小时，每片均不得有裂缝、崩解或软化现象，再在磷酸盐缓冲液（pH6.8）中进行检查，1小时内应全部崩解。结肠定位肠溶片照各品种项下规定检查，各片在盐酸溶液（9→1000）及pH6.8以下的磷酸盐缓冲溶液中均应不得有裂缝、崩解或软化现象，在pH7.5～8.0的磷酸盐缓冲液中1小时内应完全崩解。泡腾片置盛有200ml水（水温为20℃±5℃）的烧杯中，有许多气泡放出，当片剂或碎片周围的气体停止逸出时，片剂应溶解或分散在水中，无聚集的颗粒剩留，除另有规定外，各片均应在5分钟内崩解。咀嚼片（E错）、以冷冻干燥法制备的口崩片以及规定检查溶出度、释放度的片剂，一般不再进行崩解时限检查。缓释片（C错）应进行释放度检查，故不再进行崩解时限检查。